以下关于鸠尾固位形的说法哪个是错误的
A. 可增加修复体的固位力
B. 可防止修复体的水平脱位
C. 鸠尾峡的宽度为（牙合）面宽度的1/2左右
D. 鸠尾峡应位于（牙合）面牙尖三角嵴之间
E. 鸠尾的制备对预备体的抗力有影响

正确答案：C。鸠尾峡的宽度为（牙合）面宽度的1/2左右

解析：本题考查鸠尾固位形。关于鸠尾固位形的说法错误的是鸠尾峡的宽度为（牙合）面宽度的1/2左右（C错，为本题的正确答案）。鸠尾是一种常用的修复体的固位形，在邻（牙合）洞时使用，目的是为了增加修复体的固位力（A对），同时鸠尾扣可以防止水平脱位（B对）。鸠尾扣的大小、形状应根据（牙合）面形态而定，在（牙合）面沟槽处可适当扩展，尽量保留牙尖三角嵴，位于（牙合）面牙尖三角嵴之间（D对），自然形成鸠尾扣；鸠尾峡宽度也要根据（牙合）面的宽度而定，磨牙一般为颊舌尖宽度的1/3左右，前磨牙为1/2左右。鸠尾为固位形，但鸠尾的制备对抗力也有一定的影响，制备的过窄，修复体容易折断，过宽则降低预备体的抗力，牙尖容易折裂（E对）。